因质地疏松，粉性大，不宜切薄片的药材是
A. 甘草
B. 槟榔
C. 白芍
D. 三棱
E. 乌药

正确答案：A。甘草

解析：本题考查的是常见的饮片类型、规格及适用的品种。因质地疏松，粉性大，不宜切薄片的药材是甘草（A对）。片：片按照厚度可分为极薄片、薄片、厚片。极薄片的厚度要求为0.5mm以下；薄片的厚度要求为1～2mm；厚片的厚度要求为2～4mm。根据药材质地，一般质疏松宜厚，质密坚宜薄。质地极其致密坚实的木质类、动物骨和角类药材，宜切极薄片，如羚羊角、鹿角、降香等。质地致密、坚实者，宜切薄片，如乌药（E错）、槟榔（B错）、当归、白芍（C错）、三棱（D错）等。质地松泡、粉性大者，宜切厚片，如山药、天花粉、茯苓、甘草、黄芪、南沙参等。按照片型可分为顶片、斜片、直片。为了突出鉴别特征，或为了饮片外形的美观，或为了方便切制操作，视不同情况选择，直片如白术、天麻、附子等。斜片如桂枝、桑枝等